位于延髓和颈髓的是
A. 面神经核
B. 展神经核
C. 副神经核
D. 滑车神经核
E. 无

正确答案：C。副神经核

解析：展神经核（B错）位于脑桥下部，面神经丘的深面；面神经核（A错） 位于脑桥下部，被盖腹 外侧的网状结构内，展神经核的腹外侧；副神经核（C对）包括两部分：延髓部较小，实为疑核的下端；脊髓部位于疑核的下方，延伸至上 5 -6 节颈髓的前角背外侧；滑车神经核（D错）位于中脑下丘高度，中脑导 水管周 围灰质的腹内侧。